仿制药一致性评价中，在相同试验条件下，仿制药品与参比药品生物等效是指
A. 两种药品在吸收速度上无显著性差异
B. 两种药品在消除时间上无显著性差异
C. 两种药品在动物体内表现相同治疗效果
D. 两种药品吸收速度与程度无显著性差异
E. 两种药品在体内分布、消除的速度与程度一致

正确答案：D。两种药品吸收速度与程度无显著性差异

解析：本题考查仿制药一致性评价。仿制药一致性评价中，在相同试验条件下，仿制药品与参比药品生物等效是指两种药品吸收速度与程度无显著性差异（D对）。生物等效性（BE）是指在相似的实验条件下单次或多次给予相同剂量的试验药物后，受试制剂中药物的吸收速度和吸收程度与参比制剂的差异在可接受范围内，反映其吸收程度和速度的主要药动学参数无统计学差异。